下列各项，不属于急性重型肝炎典型表现的是
A. 黄疸迅速加深
B. 出血倾向明显
C. 肝肿大
D. 出现烦躁、谵妄等神经系统症状
E. 急性肾功能不全

正确答案：C。肝肿大

解析：急性肝衰竭：急性起病，2周内出现Ⅱ度及以上肝性脑病（按Ⅳ度分类法划分），出现烦躁、谵妄等神经系统症状（D对），并有以下表现者：极度乏力，并有明显厌食、腹胀、恶心、呕吐等严重消化道症状；黄疸迅速加深（A对）；出血倾向明显（B对），PTA≦40%，且排除其他原因；肝脏进行性缩小（C错，为本题正确答案）；严重肝病终末期会并发肝肾综合征而出现急性肾功能不全（E对）。